以下可用于治疗抑郁症的药物是
A. 氯丙嗪
B. 奋乃静
C. 氯氮平
D. 丙米嗪
E. 氟哌啶醇

正确答案：D。丙米嗪

解析：本题考查丙米嗪、碳酸锂、氟西汀。丙米嗪（D对）治疗抑郁症：用于各种原因引起的抑郁症，对内源性抑郁症、更年期抑郁症效果较好。对反应性抑郁症次之，对精神病的抑郁成分效果较差。